医学道德修养的方法包括
A. 实践方法
B. 学习方法
C. 立志方法
D. 躬行方法
E. 自我反省

正确答案：E。自我反省

解析：医学道德修养的方法包括：自我反省、见贤思齐、坚持慎独。掌握“医学道德修养”知识点。